青春型精神分裂症的特征是
A. 明显的精神运动紊乱和木僵交替为主
B. 阴性症状为主，注意力减弱
C. 偏执性妄想
D. 精神活动的全面紊乱和瓦解
E. 持续存在阴性症状或某些个别的阳性症状，意志减退

正确答案：D。精神活动的全面紊乱和瓦解

解析：青春型精神常为青年期起病，起病常为急性或亚急性，以精神活动的全面紊乱和瓦解（思维、情感和行为的不协调或解体）（D对）为主要临床表现。明显的精神运动紊乱和木僵交替是紧张型精神分裂症的特征表现（A错）。以阴性症状为主，注意力减弱是单纯型精神分裂症的特征表现（B错）。偏执性妄想是偏执型精神分裂症的特征表现（C错）。